新生儿使用某种药物时易发生蓄积性中毒，如氯霉素可导致“灰婴综合征”，其主要原因是
A. 新生儿有较高的药物血浆蛋白结合率
B. 新生儿的药酶系统发育不完全
C. 新生儿的药物吸收较完全
D. 新生儿的胃肠蠕动能力弱
E. 新生儿阻止药物分布的屏障功能发育不完全

正确答案：B。新生儿的药酶系统发育不完全

解析：本题考查药物毒性产生原因。新生儿由于体内药酶系统发育不完全（B对），在使用氯霉素时，不能使氯霉素和葡萄糖醛酸形成结合物而排出体外，导致药物在体内聚集，引起“灰婴综合征”。